在苯二氮䓬结构中的3位引入羟基后，极性增加、毒性降低的镇静催眠药是
A. 咪达唑仑
B. 奥沙西泮
C. 依替唑仑
D. 奥沙唑仑
E. 艾司唑仑

正确答案：B。奥沙西泮

解析：本题考查镇静催眠药的结构改造。奥沙西泮（B对）是地西泮在3位上引入羟基得到的，可以增加其分子的极性，易于与葡萄糖醛酸结合排出体外，降低毒性。